大豆与谷类食物混食，主要补充谷类中最缺乏的必需氨基酸是
A. 赖氨酸
B. 苏氨酸
C. 蛋氨酸
D. 亮氨酸
E. 异亮氨酸

正确答案：A。赖氨酸

解析：谷类食物中有丰富的蛋氨酸，但是缺乏赖氨酸（A对）。相反豆类食物中缺乏蛋氨酸有丰富的赖氨酸。两者一起食用叫做蛋白质互补作用，可以提高膳食蛋白质的营养价值。